发出分支分布于胃
A. 桡动脉
B. 脾动脉
C. 肠系膜上动脉
D. 腹腔干
E. 肝总动脉

正确答案：D。腹腔干

解析：腹腔干（D对）发出分支胃左动脉分布于食管的腹段、胃的贲门和胃小弯附近的胃壁。